女，35岁。2周前发热、咳嗽、咳黄痰，经抗炎治疗后好转。近3天再次高热、咳嗽、胸闷。查体：T39.5℃，P115次/分，R24次/分，气管右移，左侧语颤减弱，叩诊实音，呼吸音消失。血WBC22×10⁹/L。胸部X线片示：左侧外高内低阴影，膈面消失。最有效的治疗措施是
A. 胸膜剥脱术
B. 胸廓成形术
C. 胸腔闭式引流
D. 雾化吸入治疗，促进排痰
E. 静脉点滴广谱抗生素

正确答案：C。胸腔闭式引流

解析：患者高热、咳嗽、胸闷，查体：气管右移，左侧语颤减弱，叩诊实音，呼吸音消失。X线片示：左侧外高内低阴影，膈面消失。考虑诊断为中大量胸腔积液。最有效的治疗措施是胸腔闭式引流（C对）（P122）。